根据《医疗机构药事管理规定》，关于医疗机构药事管理的说法，错误的是
A. 是保证医疗机构药品质量，保障公众用药安全，维护公众身体健康的相关活动
B. 对临床用药全过程进行有效的组织实施与管理
C. 是以患者为中心，以临床医学为基础的综合管理
D. 是促进临床科学、合理用药的药学技术服务和相关的药品管理工作

正确答案：C。是以患者为中心，以临床医学为基础的综合管理

解析：本题考查医疗机构药事管理。根据《医疗机构药事管理规定》，关于医疗机构药事管理的说法，错误的是是以患者为中心，以临床医学为基础的综合管理（C错，为本题正确答案）。为加强医疗机构药事管理，促进药物合理应用，保障公众身体健康（A对），根据《中华人民共和国药品管理法》、《医疗机构管理条例》和《麻醉药品和精神药品管理条例》等有关法律、法规，制定《医疗机构药事管理规定》。本规定所称医疗机构药事管理，是指医疗机构以病人为中心，以临床药学为基础，对临床用药全过程进行有效的组织实施与管理（B对），促进临床科学、合理用药的药学技术服务和相关的药品管理工作（D对）。